上颌窦癌根据肿瘤发生的部位，临床上可出现不同的症状
A. 肿瘤发生自上颌窦下壁，常先使眼球突出、向上移位，可能引起复视
B. 肿瘤发生自上颌窦内壁，常表现为面部及唇颊沟肿胀，以后皮肤破溃、肿瘤外露
C. 肿瘤发生自上颌窦后壁，常表现为眶下神经受累可发生面颊部感觉迟钝或麻木
D. 肿瘤发生自上颌窦上壁，常先使眼球突出、向上移位，可能引起复视
E. 肿瘤发生自上颌窦外壁，常先出现鼻阻塞、鼻出血，一侧鼻腔分泌物增多，鼻泪管阻塞有流泪现象

正确答案：D。肿瘤发生自上颌窦上壁，常先使眼球突出、向上移位，可能引起复视

解析：肿瘤发生自上颌窦上壁时，常先使眼球突出、向上移位，可能引起复视。掌握“中央性颌骨癌及上颌窦癌”知识点。